香囊中含有与天然麝香相同的麝香酮、降麝香酮成分的动物是
A. 复齿鼯鼠
B. 麝鼠
C. 中华鼢鼠
D. 大灵猫
E. 小灵猫

正确答案：B。麝鼠